社区构成的五要素有
A. 一定数量的人口、一定的地域、生活服务设施、文化背景、生活方式
B. 一定数量的人口、一定的地域、生活服务设施、管理机构、生活方式
C. 一定数量的人口、一定的地域、生活服务设施、文化背景、管理机构
D. 一定数量的人口、一定的地域、管理机构、文化背景、生活方式

正确答案：C。一定数量的人口、一定的地域、生活服务设施、文化背景、管理机构

解析：本题考查社区构成的五要素。社区构成的五要素有：一定数量的人口、一定的地域、生活服务设施、文化背景、管理机构（C对ABD错）。